脱疽表现为患肢黯红而肿，患肢如煮熟之红枣，渐变为紫黑色，呈浸淫蔓延，溃破腐烂，疼痛异常，彻夜不得安眠。其证候是
A. 寒湿阻络
B. 血脉瘀阻
C. 湿热毒盛
D. 热毒伤阴证
E. 气阴两虚

正确答案：C。湿热毒盛

解析：寒湿阻络证证候：患指（趾）喜暖怕冷，麻木，酸胀疼痛，多走则疼痛加剧，稍歇痛减，皮肤苍白，触之发凉，趺阳脉搏动减弱；舌淡，苔白腻，脉沉细。（A错）血脉瘀阻证证候：患趾（指）酸胀疼痛加重，夜难入寐，步履维艰，患趾（指）皮色暗红或紫暗，下垂更甚，皮肤发凉干燥，肌肉萎缩，趺阳脉搏动消失；舌暗红或有瘀斑，苔薄白，脉弦涩。（B错）湿毒热盛证证候：患肢剧痛，日轻夜重，局部肿胀，皮肤紫暗，浸淫蔓延，破溃腐烂，肉色不鲜；身热口干，便秘溲赤；舌红，苔黄腻，脉弦数。（C对）热毒伤阴证证候：皮肤干燥，毫毛脱落，趾（指）甲增厚变形，肌肉萎缩，趾（指）呈干性坏疽；口干欲饮，便秘溲赤；舌红，苔黄，脉弦细数。（D错）气阴两虚证证候：病程日久，坏死组织脱落后疮面久不愈合，肉芽暗红或淡而不鲜；倦怠乏力，口渴不欲饮，面色无华，形体消瘦，五心烦热；舌淡尖红，少苔，脉细无力。（E错）